患儿患小细胞低色素性贫血，证属脾胃虚弱。其治法是
A. 健运脾胃
B. 补益肝肾
C. 益气补血
D. 消积理脾
E. 补中益气

正确答案：A。健运脾胃

解析：营养性缺铁性贫血是由于体内铁缺乏，使血红蛋白合成减少，临床即以小细胞低色素性贫血、血清铁蛋白减少和铁剂治疗有效为特点的贫血症。其中，可由脾胃虚弱，气血生化不足所致，当治以健脾运胃，益气养血（A对）。补益肝肾（B错）属于贫血之肝肾阴虚证的治法。益气补血（C错）为健脾运胃达到的目标。消积理脾（D错）适用于脾虚夹积证的治疗。补中益气（E错）适用于气虚证的治疗。